可控制惊厥症状的药物是
A. 苯巴比妥
B. 安定
C. 吗啡
D. 苯妥英钠
E. 氯丙嗪

正确答案：A、B。苯巴比妥；安定

解析：本题考查苯巴比妥。苯巴比妥（A对）可用于镇静催眠，还可调节钠、钾、钙通道，阻滞Na⁺依赖性动作电位的快速发放，调节Na⁺，K⁺-ATP转化酶活性，从而达到抗惊厥作用；安定（B对）即地西泮，是苯二氮䓬类镇静催眠药，是临床上抗惊厥和抗惊厥持续状态的首选药；吗啡（C错）主要用于全身麻醉的诱导和维持、术后止痛；苯妥英钠（D错）可用于癫痫大发作和局限性发作；氯丙嗪（E错）可用于治疗精神分裂症。